根据《抗菌药物临床应用管理办法》，应当取消药师调剂资格的情形包括
A. 未按照规定对处方适宜性进行审核，造成严重后果的
B. 发现超常处方无正当理由而不进行干预的
C. 发现处方不适宜，无正当理由而不进行干预的
D. 没有开展细菌耐药监测工作的
E. 没有开展细菌感染流行病学调查工作的

正确答案：A、B、C。未按照规定对处方适宜性进行审核，造成严重后果的；发现超常处方无正当理由而不进行干预的；发现处方不适宜，无正当理由而不进行干预的

解析：本题考查的是抗菌药物的监督管理。根据《抗菌药物临床应用管理办法》，应当取消药师调剂资格的情形包括未按照规定对处方适宜性进行审核，造成严重后果的（A对）、发现超常处方无正当理由而不进行干预的（B对）、发现处方不适宜，无正当理由而不进行干预的（C对）。医疗机构应当对出现抗菌药物超常处方3次以上且无正当理由的医师提出警告，限制其特殊使用级和限制使用级抗菌药物处方权。医师出现下列情形之一的，医疗机构应当取消其处方权：抗菌药物考核不合格的；限制处方权后，仍出现超常处方且无正当理由的；未按照规定开具抗菌药物处方，造成严重后果的；未按照规定使用抗菌药物，造成严重后果的；开具抗菌药物处方牟取不正当利益的。药师未按照规定审核抗菌药物处方与用药医嘱，造成严重后果的，或者发现处方不适宜、超常处方等情况未进行干预且无正当理由的，医疗机构应当取消其药物调剂资格。医师处方权和药师药物调剂资格取消后，在6个月内不得恢复其处方权和药物调剂资格。